胆固醇在体内不能转变生成的物质是
A. 维生素D₃
B. 雄激素
C. 雌激素
D. 醛固酮
E. 胆色素

正确答案：E。胆色素